马斯洛需要层次论中最高层次需要是
A. 生理需要
B. 安全需要
C. 爱与被爱的需要
D. 尊重的需要
E. 自我实现的需要

正确答案：E。自我实现的需要

解析：马斯洛将需要划分为5个不同的层次，从最低层次的生理需要，到最高层次的自我实现的需要。掌握“需要与动机”知识点。